损伤后导致对侧躯体感觉消失
A. 三叉丘系
B. 脊髓丘束
C. 内侧丘系
D. 外侧丘系
E. 内囊后肢

正确答案：B。脊髓丘束

解析：躯体感觉与躯干和四肢痛温觉、粗略触觉和压觉传导通路有关，该通路中，传导痛温觉的纤维（细纤维）在后根的外侧部入脊髓后角内，再终止于第2级神经元；传导粗略触觉和压觉的纤维（粗纤维）经后根内侧部进入脊髓后角内，再终止于第2级神经元。第二级神经元发出纤维上升 1-2 个节段经白质前连合交叉到对侧的外侧索和前索内上行，组成脊髓丘脑侧束和脊髓丘脑前束（侧束传导痛温觉，前束传导粗略触觉和压觉）（B对）。患者对侧躯体觉消失，可见是由于传导痛温觉和触觉的神经纤维在脊髓丘系处存在病变。